最理想的防毒措施是
A. 降低空气中的毒物浓度至最高浓度以下
B. 加强个人防护
C. 积极锻炼身体，增强体质
D. 从根本上消除毒物
E. 加强环境监测

正确答案：D。从根本上消除毒物